我国的《传染病防治法》规定的丙类传染病包括
A. 病毒性肝炎、痢疾
B. 艾滋病、狂犬病
C. 风疹、急性出血性结膜炎
D. 鼠疫、天花
E. 天花、霍乱

正确答案：C。风疹、急性出血性结膜炎